下面哪个不是观察性流行病学研究方法
A. 病例对照研究
B. 现况研究
C. 生态学研究
D. 社区试验
E. 队列研究

正确答案：D。社区试验